根据生理效应，肾上腺素受体分为α受体和β受体，受体分为α₁、α₂等亚型，β受体分为β₁、β₂等亚型。α₁受体的功能主要为收缩血管平滑肌，增强心肌收缩力；α₂受体的功能主要为抑制心血管活动，抑制去甲肾上腺素、乙酰胆碱和胰岛素的释放，同时也具有收缩血管平滑肌作用。β₁受体的功能主要为增强心肌收缩力，加快心率等；β₂受体的功能主要为松弛血管和支气管平滑肌。人体中，心房以β₁受体为主，但同时含有四分之一的β₂受体，肺组织β₁和β₂之比为3：7，根据β受体分布并结合受体作用情况，下列说法正确的是
A. 非选择性β受体阻断药，具有较强抑制心肌收缩力作用，同时具有引起支气管痉挛及哮喘的副作用
B. 选择性β₁受体阻断药，具有较强的增强心肌收缩力作用，临床可用于强心和抗休克
C. 选择性β₂受体阻断药，具有较强的抑制心肌收缩力作用，同时具有引起体位性低血压的副作用
D. 选择性β₁受体激动药，具有较强扩张支气管作用，可用于平喘和改善微循环
E. 选择性β₂受体激动药，比同时作用α和β受体的激动药具有更强的收缩外周血管作用，可用于抗休克

正确答案：A。非选择性β受体阻断药，具有较强抑制心肌收缩力作用，同时具有引起支气管痉挛及哮喘的副作用

解析：本题考查非选择性β受体阻断药。非选择性β受体阻断药（A对），具有较强抑制心肌收缩力作用，同时具有引起支气管痉挛及哮喘的副作用。